下列属于人体条件必需氨基酸的是
A. 甘氨酸
B. 半胱氨酸
C. 色氨酸
D. 缬氨酸
E. 谷氨酰胺

正确答案：B。半胱氨酸